CD3分子具有
A. 中和作用
B. 免疫调节作用
C. 传导活化信号作用
D. 趋化作用
E. 引起DTH作用

正确答案：C。传导活化信号作用